全口义齿摘戴时疼痛，定位明确，戴入后无明显不适。其原因是
A. 基托边缘过长
B. 基托进入组织倒凹
C. 基托组织面有小结节
D. 骨隆突处未缓冲
E. 基托不密合

正确答案：B。基托进入组织倒凹

解析：本题考查戴用义齿后可能出现的问题及原因。全口义齿摘戴时疼痛，定位明确，说明基托组织面可能局部缓冲不足，义齿在戴上或取下时，基托组织面缓冲不足的区域会造成倒凹区黏膜的擦伤而出现疼痛，当全口义齿带入后，即义齿完全就位没有明显疼痛，说明义齿缓冲不足区域进入倒凹区（B对），对黏膜的压迫明显减小。基托边缘过长（A错）会导致义齿固位不良，不会导致明显的疼痛，更不会出现摘戴时疼痛，戴入后无明显不适的状况。基托组织面有小结节（C错）会出现黏膜的明显压痛，尤其在义齿完全就位后疼痛明显。骨隆突处未缓冲（D错）与基托组织面有小结节的情况类似，会出现黏膜压痛。基托不密合（E错）会出现义齿固位差的问题，一般没有明显疼痛症状。